一患肾炎5年的病人，近1周来乏力、呼吸深大。查体：双肺无啰音，心率90次/分，应采取下列哪项措施
A. 静脉缓注西地兰
B. 静注速尿
C. 肌注喘定
D. 静滴碳酸氢钠
E. 呼吸中枢兴奋剂

正确答案：D。静滴碳酸氢钠